下列对可摘局部义齿大连接体的要求，除外的是
A. 杆的边缘应圆钝
B. 一般呈圆形或卵圆形
C. 不能妨碍唇、颊、舌的运动
D. 有一定的强度、质地坚韧、不变形
E. 不能压迫上颌腭隆突、下颌舌隆突及其他骨性突起

正确答案：B。一般呈圆形或卵圆形

解析：对大连接体的要求①有一定的强度、质地坚韧、不变形、不断裂；②不能妨碍唇、颊、舌的运动；③根据不同的位置、受力情况和组织情况，可呈不同的大小、外形和厚度，一般呈扁平形或板条形。连接杆的弹性随长度而增加。因此，若杆的长度增加，应相应地增加厚度。杆的边缘应圆钝；④不能进入软组织倒凹，以免影响义齿就位和压伤软组织。不能压迫上颌腭隆突、下颌舌隆突及其他骨性突起。掌握“局部义齿连接体”知识点。